tRNA分子上3'端序列的功能是
A. 辨认mRNA上的密码子
B. 剪接修饰作用
C. 辨认与核糖体结合的组分
D. 提供-OH基与氨基酸结合
E. 提供-OH基与糖类结合

正确答案：D。提供-OH基与氨基酸结合